某药物按一级反应降解，若K25℃=0.000248（天-1），则该药物的有效期为
A. 279天
B. 375天
C. 425天
D. 516天
E. 2794天

正确答案：C。425天

解析：本题考查一级反应降解的计算公式。某药物按一级反应降解，若K25℃=0.000248（天-1），则该药物的有效期为425天（C对）。将药物在室温下降解10%所需的时间作为有效期（t0.9），降解50%所需时间为半衰期（t½），其计算公式分别为，一级反应：t0.9=0.1054/K；t½=0.693/K。\